做到用药不滥，有利于环境保护，指的是合理用药的
A. 实用性
B. 安全性
C. 经济性
D. 有效性
E. 科学性

正确答案：C。经济性

解析：本题考查的是合理用药的原则。做到用药不滥，有利于环境保护，指的是合理用药的经济性（C对）。合理用药的原则：1.安全（B错）：所谓安全，即保证用药安全。药物因本身固有的药理学特性在发挥治疗作用的同时，也会对机体产生不同程度的损害或改变病原体对药物的敏感性，甚至产生药源性疾病。因此保证患者用药安全是药物治疗的前提。一名合格的执业药师在建议临床医师或指导患者使用中药或中成药时，必须把保证患者用药安全放在首位。无论所使用的药物是有毒者，还是无毒者，均应首先考虑所用药物是否安全，是否会对患者造成不良反应。同时在用药过程中，还要针对所用药物或出现的意外情况，建议医师或患者采取相应措施，以达到消除或减少药物不良反应之目的。2.有效（D错）：所谓有效，即确保用药有效。一名合格的执业药师在建议临床医师或指导患者使用中药或中成药时，必须在用药安全的前提下，选择所用药物对所防治的疾病有效。力争做到在药学服务中，所推选的中药或中成药对患者既尽可能不会造成伤害，又有较好的疗效。使患者用药后能迅速达到预期目的，解除患者的病痛，或提高使用者的健康水平。这也是治愈或缓解患者病痛或强健用药者身体的最佳选择。3.简便：所谓简便，即提倡用药方法要简便。一名合格的执业药师在建议临床医师或指导患者使用中药或中成药时，必须在用药安全、有效的前提下，力争做到所推选药物的使用方法简便易行，使临床医师及使用者易于掌握，应用方便。4.经济：所谓经济，即倡导用药要经济实用。一名合格的执业药师在建议临床医师或指导患者使用中药或中成药时，必须在用药安全、有效的前提下，除力争做到所推选的药物用法简便外，还必须做到用药不滥、经济实用，并有利于环境保护。最大限度地减轻患者的经济负担、降低中药材等卫生资源的消耗。总之，合理用药的基本原则就是安全、有效、简便、经济，四者缺一不可。既要权衡患者应用药物所获得的收益，又要考虑用药后对患者可能造成的伤害；既要考虑药物的疗效与治疗疾病的需要，又要顾及患者的经济承受能力及保护卫生资源与生态环境。并以此为宗旨，制定出最好的药物治疗方案，进而达到：最大限度地发挥药物的治疗效果，减少药物不良反应的发生；有效地防治疾病，提高患者的生命质量，降低发病率；控制医疗保健费用的过度增长，使社会和患者都获得最佳效益。实用性（A错）与科学性（E错），2022年考试指南未明确说明。